女，18周，发热1天抽搐1次，发作15分钟无缓解送急诊，查体.体温39.5，无意识，双眼上翻，四肢抽搐。现首选药物是
A. 口服水合氯醛
B. 肌注苯巴比妥
C. 静推苯妥英钠
D. 静推地西泮
E. 静推硫喷妥钠

正确答案：D。静推地西泮

解析：患者女，18周，发热1天抽搐1次，发作15分钟无缓解送急诊，查体.体温39.5，无意识，双眼上翻，四肢抽搐（惊厥的表现）。结合患者的表现，现首选药物是静推地西泮（D对）。（P376）10%水合氯醛：用于上述治疗无效时…目前国内，在没有条件很快使用静脉注射地西洋或者肌内注射咪达唑仑的情况下，也可以作为首选止惊治疗（A错）。（P376）苯巴比妥钠：肌注吸收较慢，不适宜用于急救的一线用药，可选用静脉制剂（B错）。（P376）苯妥英：用于惊厥持续状态（C错）。E选项不属于惊厥治疗的首选药物。